马钱子的炮制方法宜选用
A. 炒焦法
B. 砂炒法
C. 土炒法
D. 麸炒法
E. 蛤粉炒法

正确答案：B。砂炒法

解析：本题考查炒法的分类。马钱子的炮制方法宜选用砂炒法（B对）。砂炒法：将净选或切制后的药物与热砂共同拌炒的方法，称为砂炒法，亦称砂烫法。砂炒的目的：①增强疗效，便于调剂和制剂，如狗脊、穿山甲等。②降低毒性，如马钱子等。③便于去毛，如骨碎补等。④矫臭矫味，如鸡内金等。炒焦法（A错）：炒焦是将净选或切制后的药物，置炒制容器内，用中火或武火加热，炒至药物表面呈焦黄或焦褐色，内部颜色加深，并具有焦香气味。炒焦的目的：主要是增强药物消食健脾的功效或减少药物的刺激性，如山楂、栀子等。土炒法（C错）：将净选或切制后的药物与灶心土（伏龙肝）拌炒的方法，称为土炒。亦有用黄土、赤石脂炒者。土炒的目的：灶心土味辛性温，能温中燥湿，止呕，止泻。明《本草蒙筌》有“陈壁土制，窃真气骤补中焦”的记载。故常用来炮制补脾止泻的药物。如白术、山药等。麸炒法（D错）：将净制或切制后的药物用麦麸熏炒的方法，称为麸炒。麸炒的目的：①增强疗效，如山药、白术、芡实等。②缓和药性，如苍术、枳实、薏苡仁等。③矫臭矫味，如僵蚕等。蛤粉炒法（E错）：将净制或切制后的药物与蛤粉共同拌炒的方法，称为蛤粉炒或蛤粉烫。蛤粉炒的目的：①使药物质地酥脆，便于制剂和调剂。②降低药物的滋腻之性，矫正不良气味。如阿胶、鹿角胶等。